根据卫生部等九部委局《关于建立国家基本药物制度的实施意见》，基本药物应满足的条件包括
A. 适应基本医疗卫生需求
B. 公众可公平获得
C. 能够保障供应
D. 剂型适宜
E. 价格合理

正确答案：A、B、C、D、E。适应基本医疗卫生需求；公众可公平获得；能够保障供应；剂型适宜；价格合理

解析：本题考查的是基本药物应满足的条件。根据卫生部等九部委局《关于建立国家基本药物制度的实施意见》，基本药物应满足的条件包括适应基本医疗卫生需求（A对）、公众可公平获得（B对）、能够保障供应（C对）、剂型适宜（D对）、价格合理（E对）。基本药物是指满足疾病防治基本用药需求，适应现阶段基本国情和保障能力，剂型适宜，价格合理，能够保障供应，可公平获得的药品。